由胰岛A细胞分泌
A. 胰蛋白酶
B. 胰多肽
C. 生长抑素
D. 胰岛素
E. 胰高血糖素

正确答案：E。胰高血糖素

解析：胰岛A细胞也称胰岛α细胞，分泌胰高血糖素(E对)。